水体的硬度取决于
A. 水中碳酸盐的含量
B. 水中硫酸盐的含量
C. 水中钙、镁离子的含量
D. 水中钙、镁盐类的含量
E. 水中氯化钙的含量

正确答案：C。水中钙、镁离子的含量

解析：本题考查水体的硬度取决因素。水的硬度指溶于水中钙、镁盐类的总含量，水体的硬度取决于水中钙、镁离子的含量（C对ABDE错）。